流行性脑脊髓膜炎皮肤严重出血的改变是
A. 斑丘疹
B. 玫瑰疹
C. 搔抓样瘀点
D. 红斑疹
E. 皮肤坏死

正确答案：E。皮肤坏死

解析：流行性脑脊髓膜炎是由脑膜炎球菌引起的急性化脓性脑膜炎，简称为流脑。其败血症期大多数患者，发病数小时后全身皮肤、黏膜出现瘀点或瘀斑，直径1mm～lcm5严重者瘀点、瘀斑数量迅速增多、扩大，形成大片坏死或血疱，结膜可有充血。而休克型流脑短期内瘀点迅速增多、扩大、融合成片，中央呈紫黑色坏死（E对），且遍及全身。斑丘疹（A错）多见于风疹、猩红热、湿疹及药物疹等。玫瑰疹（B错）为伤寒患者在极期出现典型临床表现，半数患者在病程第7～14天皮肤出现淡红色斑丘瘆，称为玫瑰疹，直径约2～4mm，压之退色，多在10个以下，分批出现，主要分布于胸、腹及肩背部，四肢少见，常于2～4天内变淡、消失。搔抓样瘀点（C错）为流行性出血热的典型皮肤出血改变，表现为腋下、上胸部、颈及肩部等皮肤有散在、簇状或搔抓状、条索样出血点。红斑疹（D错）多见于过敏性湿疹，主要是因为过敏性体质受到过敏源刺激，进而引起皮肤发炎的反应。